下列哪一种物质不属于尿毒症毒素
A. 胍类
B. 胺类
C. 尿素
D. 降钙素
E. 甲状旁腺素

正确答案：D。降钙素

解析：常见的尿毒症毒素有：(1)甲状旁腺激素（E对）(2) 胍类化合物（A对）(3) 尿素（C对）(4)多胺（B对）(5)中分子量物质。此外，肌酐、尿酸、酚类、晚期糖基化终末产物、12-微球蛋白等，对机体也有 一定毒性作用。而降钙素（D错，为本题正确答案）不属于尿毒症毒素。